乳癖，证属冲任失调的临床表现
A. 乳房胀痛
B. 大便溏泻
C. 月经紊乱
D. 胸闷胁胀
E. 心烦易怒

正确答案：C。月经紊乱

解析：本题考查的是乳癖的辨证论治。乳癖，证属冲任失调的临床表现月经紊乱（C对）。乳癖，是乳腺组织的既非炎症也非肿瘤的良性增生性疾病。临床特点是单侧或双侧乳房疼痛并出现肿块，乳痛和肿块与月经周期及情志变化密切相关。乳房肿块大小不等，形态不一，边界不清，质地不硬，活动度好。常见于中青年妇女，是临床最常见的乳房疾病。西医学的乳腺小叶增生、乳房囊性增生等疾病表现为上述症状者，可参考此内容辨证论治。（一）肝郁痰凝证：【症状】多见于青壮年妇女。乳房肿块，质韧不坚，胀痛（A错）或刺痛，症状常随喜怒消长；伴胸闷胁胀（D错），善郁易怒（E错），失眠多梦，心烦口苦。舌苔薄黄，脉弦滑。（二）冲任失调证：【症状】多见于中年妇女。乳房肿块月经前加重，经后缓解；伴腰膝酸软，神疲倦怠，月经失调，量少色淡，或闭经。舌质淡，苔白，脉沉细。大便溏泻（B错）是脾失健运证的临床表现。脾失健运证：临床表现常见食纳减少，食后作胀，或肢体浮肿，小便不利，或大便溏泻，时息时发，并伴有身倦无力、气短懒言、面色萎黄、舌质淡嫩、苔白、脉缓弱。以运化功能减退和气虚证共见为辨证要点。